男，21岁。突起四肢无力1周。查体：四肢肌力2级，肌张力低，腱反射消失，病理征未引出，无明显感觉障碍，双侧腓肠肌压痛。该患者最常见的病原体是
A. CJ
B. HPV
C. EB病毒
D. HBV
E. HIV

正确答案：A。CJ

解析：男，21岁。突起四肢无力1周（诱因未明）。查体：四肢肌力2级，肌张力低，腱反射消失，病理征未引出，无明显感觉障碍，双侧腓肠肌压痛（吉兰巴雷综合征典型表现），骨患者考虑诊断为吉兰巴雷综合征，该患者最常见的病原体是空肠弯曲菌（CJ）（A对），以腹泻为前驱症状的GBS患者CJ感染率高达85%，常引起急性运动轴索性神经病。HPV（B错）为人类乳头瘤病毒，感染可引起生殖器湿疣、子宫颈癌等。EB病毒（C错）感染可引起淋巴瘤、鼻咽癌。HBV（D错）为乙型肝炎病毒，可引起乙型肝炎。HIV（E错）是人类免疫缺陷病毒，感染可引起艾滋病。